属于黏痰溶解剂，具有较强的黏痰溶解作用，也可用于治疗环磷酰胺引起的出血性膀胱炎的药物是
A. 愈创甘油醚
B. 氨溴索
C. 乙酰半胱氨酸
D. 羧甲司坦
E. 糜蛋白酶

正确答案：C。乙酰半胱氨酸

解析：本题考查对乙酰氨基酚的中毒解救。乙酰半胱氨酸（C对）可以用于对乙酰氨基酚中毒的解救。